最易引起胎儿畸形的病毒是
A. 流感病毒
B. 埃可病毒
C. 风疹病毒
D. 轮状病毒
E. 麻疹病毒

正确答案：C。风疹病毒